胰腺癌最常见的组织类型为
A. 腺泡细胞癌
B. 导管细胞癌
C. 多形性腺癌
D. 纤维细胞腺癌
E. 黏液癌

正确答案：B。导管细胞癌

解析：胰腺癌的病理分型：导管细胞腺癌（B对）占胰腺癌的80％～90％，主要由不同分化程度的、导管样结构的腺体构成，伴有丰富的纤维间质；多形性腺癌（C错）亦称巨细胞癌，可能为导管癌的一种亚型，所占比例极少；黏液癌（E错）切面可呈胶冻状，极相似于结肠的胶样癌，所占比例很少；纤毛细胞腺癌（D错）形态与一般导管癌相同，其特点是部分细胞有纤毛，所占比例很少；腺泡细胞癌（A错）仅占1％。